关节窝顶与颅中窝之间仅有薄骨板相隔，中央最薄处厚度约
A. 0.5mm
B. 0.8mm
C. 1.2mm
D. 1.8mm
E. 2.0mm

正确答案：C。1.2mm

解析：关节窝：前界为关节结节嵴；外界为颧弓的后续部分；内后界止于岩鳞裂和鼓鳞裂（亦称鳞鼓裂），隔骨板与外耳道和中耳相邻。关节窝内侧为蝶骨嵴。关节窝顶与颅中窝之间仅有薄骨板相隔，中央最薄处可仅厚约1～2mm。掌握“颞下颌关节的解剖特点”知识点。